口服避孕药后不规则出血，正确的处理方法是
A. 加服少量雌激素
B. 需立即停药
C. 加服少量孕激素
D. 加服少量雄性激素
E. 加倍服药

正确答案：A。加服少量雌激素

解析：口服避孕药后不规则出血称为突破性出血，多数发生在漏服避孕药后，少数未漏服避孕药也能发生。轻者点滴出血，不用处理，随着服药时间延长而逐渐减少直至停止。流血偏多者，每晚在服用避孕药的同时加服少量雌激素（A对）。流血似月经量或流血时间已近月经期，则停止服药（B错）。